女，25岁。因寒战、高热、大汗，在当地医院诊断为恶性疟疾。应选用哪种治疗方案
A. 氯喹口服
B. 奎宁口服
C. 氯喹+伯氨喹
D. 奎宁+伯氨喹
E. 乙胺嘧啶

正确答案：C。氯喹+伯氨喹

解析：疟疾的药物治疗既要杀灭红内期的疟原虫以控制发作，又要杀灭红外期的疟原虫以防止复发，并要杀灭配子体以防止传播。药物的选择需根据是否是恶性疟，原虫密度大小，病情轻重，是否来自耐药流行区、局部地区的耐药类型，当地可供使用的药物来定。恶性疟疾感染即使无并发器官损害也建议应用两类药联合治疗（ABE错），以免产生耐药，保护药物的有效性。建议使用作用时间较短的药物如青蒿素及其衍生物，本题选项未涉及青蒿素类药物，氯喹、奎宁和伯氨喹属于喹啉衍生物。其中氯喹是目前非耐药疟疾的首选药物，可以有效控制疾病发作；伯氨喹能杀灭肝细胞内期及配子体，是目前唯一可供使用的预防复发和传播的药物。所以治疗方案应选择氯喹和伯氨喹联用（C对）。